骨性关节炎治疗中，能够局部外用以缓解疼痛的药物是
A. 双氯芬酸
B. 白芍总苷
C. 氨基葡萄糖
D. 曲安奈德
E. 阿达木单抗

正确答案：A。双氯芬酸

解析：本题考查骨性关节炎的药物治疗。对于手和膝关节OA，在采用口服药物前，建议首先选择局部药物治疗。可使用NSAIDs的凝胶剂、乳胶剂、膏剂、贴剂等（A对），如氟比洛芬凝胶贴膏。局部外用药可以有效缓解关节轻至中度疼痛，其胃肠道不良反应轻微。对于中至重度疼痛可联合使用局部药物与口服NSAIDs类药物。